麻疹病人解除隔离的指标是
A. 隔离至热退
B. 皮疹完全消退后
C. 出疹后5天
D. 出疹后10～14天
E. 出疹后3～4天

正确答案：C。出疹后5天

解析：麻疹病人解除隔离的指标是出疹后5天（C对），伴呼吸道并发症者应延长到出疹后10天。麻疹病毒的唯一自然储存宿主是人，急性期患者是传染源，患者在出疹前2天至出疹后5天有传染性，前驱期传染性最强，出疹后逐渐降低，疹退时已无传染性，传染期患者口鼻咽眼结合膜分泌物均含病毒，恢复期不含病毒，主要通过飞沫传播，也可经用具、玩具或密切接触传播，麻疹传染性极强，易感者接触后几乎全部发病。